2型糖尿病患者，女，60岁，因服用降糖药达格列净出现尿路感染就诊，医师建议改用胰岛素类药物治疗。达格列净属于
A. 钠-葡萄糖协同转运蛋白-2（SGLT-2）抑制药
B. 促胰岛素分泌药
C. 胰岛素增敏药
D. α-葡萄糖苷酶抑制药
E. 二肽基肽酶-4（DPP-4）抑制药

正确答案：A。钠-葡萄糖协同转运蛋白-2（SGLT-2）抑制药

解析：本题考查达格列净。达格列净属于钠-葡萄糖协同转运蛋白-2（SGLT-2）抑制药（A对）。促胰岛素分泌药（B错）常见的主要分磺酰脲类和非磺酰脲类。胰岛素增敏药（C错）常用的有罗格列酮和吡格列酮。α-葡萄糖苷酶抑制药（D错）包括阿卡波糖。二肽基肽酶-4（DPP-4）抑制药（E错）有西格列汀、维格列汀、沙格列汀等。